与痛经无关的疾病是
A. 无排卵性功血
B. 子宫粘膜下肌瘤
C. 慢性盆腔炎
D. 子宫内膜异位症
E. 子宫腺肌病

正确答案：A。无排卵性功血

解析：痛经为最常见的妇科症状之一，指行经前后或月经期出现下腹部疼痛、坠胀，伴有腰酸或其他不适。痛经分为原发性和继发性两类，原发性痛经指生殖器官无器质性病变的痛经，占痛经90%以上；继发性痛经指由盆腔器质性疾病引起的痛经。无排卵性功血（A对）是由于生殖内分泌轴功能紊乱造成的异常子宫出血，其最常见的症状是子宫不规则出血，表现为月经紊乱，在出血期间一般无腹痛或其他不适，与痛经无关。子宫黏膜下肌瘤（B错）、慢性盆腔炎（C错）均有下腹坠胀、腰酸背痛，经期加重等继发性痛经症状。子宫内膜异位症（D错）、子宫腺肌病（E错）的典型症状为继发性痛经、进行性加重。